人工流产后1年未孕应属于
A. 全不产
B. 五不女
C. 原发性不孕症
D. 继发性不孕症
E. 相对性不孕症

正确答案：D。继发性不孕症

解析：患者人工流产后，说明患者既往有过妊娠史，而后又1年未孕，属于不孕症范畴，故根据不孕症的分类，既往有过妊娠史，而后无避孕连续1年未妊娠者称为继发性不孕（D对）。原发性不孕症又称全不产，指既往从未有过妊娠史，无避孕且从未妊娠者称为原发性不孕（AC错）。